环境因素影响行为，而行为又对环境造成影响，所以环境既是行为的激发因素，又是行为的
A. 组织者
B. 接受者
C. 形成者
D. 定型者
E. 作用者

正确答案：B。接受者